急性糜烂性胃炎的确诊应依据
A. 上消化道出血的临床表现
B. 胃液分析
C. X线胃肠钡餐检查
D. 急诊胃镜检查
E. 腹部B超

正确答案：D。急诊胃镜检查

解析：急性糜烂性胃炎的确诊应依据急诊胃镜检查（D对），可见胃黏膜糜烂和出血病灶。上消化道出血的临床表现（A错）可见于消化性溃疡、肝硬化和胃癌等疾病，不具有特异性。胃液分析（B错）测定基础胃酸排泌量、最大胃酸排泌量等，可用于消化性溃疡、慢性胃炎的辅助检查。X线胃肠钡餐检查（C错）显示病灶不如胃镜清楚、直接。腹部B超检查（E错）因受气体和骨骼干扰较大，一般不用于胃部疾病的检查。